吐温80可作为
A. 乳化剂
B. 助悬剂
C. 两者均是
D. 两者均不是

正确答案：A。乳化剂

解析：本题考查表面活性剂。吐温80（A对）可作为乳化剂。吐温80为聚山梨酯80的商品名，属于非离子型乳化剂。助悬剂系指能增加分散介质的黏度以降低微粒的沉降速度或增加微粒亲水性的附加剂，吐温80不是助悬剂（BCD错）。